牙周炎的全身促进因素包括
A. 胃溃疡
B. 牙颌畸形
C. 精神压力
D. 乙型肝炎
E. 肾盂肾炎

正确答案：C。精神压力

解析：本题考查牙周病的全身促进因素。牙周炎的全身促进因素包括精神压力（C对）。牙周病的全身促进因素包括：1.遗传因素：Chediak～Higashi综合征、低磷酸酶血症和缺触酶血症、单核细胞对脂多糖的反应性；2.性激素；3.吸烟；4.有关的系统性疾病：糖尿病、吞噬细胞的减少和功能异常、艾滋病、骨质疏松症；5.精神压力。胃溃疡是一种常见的消化道疾病（A错）。牙颌畸形可引起患者精神心理障碍（B错）。乙型肝炎以肝脏炎性病变为主，可引起多器官损害，少数转为肝硬化和肝癌（D错）。肾盂肾炎是由致病菌感染引起尿路感染的常见病（E错）。